男，23岁。排便次数增多1个月。大便带血，直肠指诊于直肠侧壁触及柔软光滑的有蒂包块。最可能的诊断是
A. 血栓性外痔
B. 肛周脓肿
C. 直肠息肉
D. 肛窦炎
E. 直肠癌

正确答案：C。直肠息肉

解析：直肠侧壁触及柔软光滑有蒂包块，最可能的诊断是直肠息肉（C对）。（P404）血栓性外痔（A错）是血栓性静脉炎的一种表现，剧痛有痔核。（P399）肛周脓肿（B错）可在相应部位扪及肿块，边界不清楚，并有明显触痛，部分病人可有波动感。肛窦炎（D错）排便时疼痛。直肠癌（E错）可于直肠内扪及高低不平的肿块，质地较硬，退出手指后，指套上常有脓血和粘液。